位于上颌硬区之前，腭皱襞之后，与黏膜组织密合但无压力的为
A. 前腭板
B. “天窗”式腭板
C. 前腭杆
D. 后腭杆
E. 侧腭杆

正确答案：C。前腭杆

解析：前腭杆：位于上颌硬区之前，腭皱襞之后，薄而宽，与黏膜组织密合但无压力，应离开龈缘至少6mm。掌握“局部义齿连接体”知识点。